某女，50岁。时值更年期，患阴虚崩漏，口干口渴，舌红少苔，治宜滋阴，凉血止血。宜选用的药是
A. 龟甲
B. 鳖甲
C. 女贞子
D. 墨旱莲
E. 哈蟆油

正确答案：A、D。龟甲；墨旱莲

解析：本题考查的是龟甲、墨旱莲的功效。时值更年期，患阴虚崩漏，口干口渴，舌红少苔，治宜滋阴，凉血止血。宜选用的药是龟甲（A对）与墨旱莲（D对）。龟甲：【功效】滋阴潜阳，益肾健骨，养血补心，凉血止血。墨旱莲：【功效】滋阴益肾，凉血止血。鳖甲（B错）：【功效】滋阴潜阳，退热除蒸，软坚散结。女贞子（C错）：【功效】滋肾补肝，清虚热，明目乌发。哈蟆油（E错）：【功效】补肾益精，养阴润肺。